关于邻（牙合）面洞制成台阶的目的，错误的一项是
A. 可以去净邻面龋坏组织
B. 可以避免损伤牙髓
C. 有利于固位
D. 最小限度切割牙齿组织

正确答案：C。有利于固位

解析：本题考查窝洞的抗力形-阶梯结构。邻（牙合）面洞制成台阶的目的错误的是有利于固位（C错，为本题的正确答案）。邻（牙合）面洞预备时预备出台阶，为牙钻邻面预备时留出操作空间，有利于去净邻面龋坏组织（A对）。台阶对应的深部为髓角所在部位，台阶的预备可以避开髓角避免损伤牙髓（B对）。复面洞做成台阶，属于抗力形的一种，可以使充填体和余留牙体组织获得足够抗力，在承受咬合力时不折裂。台阶的预备保留了轴壁和髓壁交角处的牙体组织，可最小限度切割牙齿组织（D对）。